发育性根侧囊肿和牙龈囊肿的上皮来源为
A. 牙板上皮剩余
B. 上皮根鞘
C. Malassez上皮剩余
D. 釉小皮
E. 缩余釉上皮

正确答案：A。牙板上皮剩余

解析：牙板上皮剩余或Serres上皮剩余可发生发育性根侧囊肿和牙龈囊肿。掌握“牙体、牙周组织的形成”知识点。